e₇₀＝11.24岁，表示
A. 活满11.24岁的人，今后还能存活70年
B. 该受试对象实际存活了70年
C. 活满70岁的人，今后实际还能活11.24年
D. 该受试对象实际存活了11.24年
E. 活满70岁的人，今后尚有可能平均存活11.24年

正确答案：E。活满70岁的人，今后尚有可能平均存活11.24年

解析：本题考查期望寿命的解释。本题中E₇₀＝11.24岁，表示活满70岁的人，今后尚有可能平均存活11.24年（E对ABCD错）。